根据《药品管理法》第一百一十八条的规定，生产，销售劣药且情节严重的，对法定代表人主要负责人、直接负责的主管人员和其他责任人员没收违法行为发生期间自本单位所获收入，并处
A. 所获收入30%以上一倍以下罚款
B. 所获收入一倍以上三倍以下罚款
C. 所获收入30%以上三倍以下罚款
D. 所获收入一倍以五倍以下罚款

正确答案：C。所获收入30%以上三倍以下罚款

解析：本题考查法律责任。第一百一十八条生产、销售假药，或者生产、销售劣药且情节严重的，对法定代表人、主要负责人、直接负责的主管人员和其他责任人员，没收违法行为发生期间自本单位所获收入，并处所获收入百分之三十以上三倍以下的罚款（C对），终身禁止从事药品生产经营活动，并可以由公安机关处五日以上十五日以下的拘留。